叶呈卵形或椭圆形，边缘具不整齐钝锯齿，香气特异的中药材是
A. 薄荷
B. 广藿香
C. 青蒿
D. 细辛
E. 蒲公英

正确答案：B。广藿香

解析：本题考查的是广藿香药材的性状鉴别。叶呈卵形或椭圆形，边缘具不整齐钝锯齿，香气特异的中药材是广藿香（B对）。广藿香：【性状鉴别】药材茎略呈方柱形，多分枝，枝条稍曲折；表面被柔毛；质脆，易折断，断面中部有髓；老茎类圆柱形，被灰褐色栓皮。叶对生，皱缩成团，展平后叶片呈卵形或椭圆形；两面均被灰白色绒毛；先端短尖或钝圆，基部楔形或钝圆，边缘具大小不规则的钝齿；叶柄细，被柔毛。气香特异，味微苦。薄荷（A错）：【性状鉴别】药材茎呈方柱形，有对生分枝；表面紫棕色或淡绿色，棱角处具茸毛；质脆，断面白色，髓部中空。叶对生，有短柄；叶片皱缩卷曲，完整者展平后呈宽披针形、长椭圆形或卵形；上表面深绿色，下表面灰绿色，稀被茸毛，有凹点状腺鳞。轮伞花序腋生，花萼钟状，先端5齿裂，花冠淡紫色。揉搓后有特殊清凉香气，味辛凉。青蒿（C错）：【性状鉴别】药材茎呈圆柱形，上部多分枝；表面黄绿色或棕黄色，具纵棱线；质略硬，易折断，断面中部有髓。叶互生，暗绿色或棕绿色，卷缩易碎，完整者展平后为三回羽状深裂，裂片及小裂片矩圆形或长椭圆形，两面被短毛。气香特异，味微苦。细辛（D错）：【性状鉴别】药材北细辛常卷曲成团。根茎横生呈不规则圆柱形，具短分枝；表面灰棕色，粗糙，有环形的节，分枝顶端有碗状的茎痕。根细长，密生于节上；表面灰黄色，平滑或具纵皱纹；有须根及须根痕；质脆，易折断，断面平坦，黄白色或白色。气辛香，味辛辣、麻舌。蒲公英（E错）：【性状鉴别】药材呈皱缩卷曲的团块。根呈圆锥形，多弯曲；表面棕褐色，抽皱；根头部有棕褐色或黄白色的茸毛，有的已脱落。叶基生，多皱缩破碎，完整叶片呈倒披针形，绿褐色或暗灰绿色，先端尖或钝，边缘浅裂或羽状分裂，基部渐狭，下延呈柄状，下表面主脉明显。花茎一至数条，每条顶生头状花序，总苞片多层，内面一层较长，花冠黄褐色或淡黄白色。有的可见多数具白色冠毛的长椭圆形瘦果。气微，味微苦。